患者，女，26岁，乳头及乳晕皮肤破裂，分泌脂水，结黄色痂，小儿吸吮时，痛如刀割，应选用的方剂是
A. 橘叶瓜蒌散
B. 五味消毒饮
C. 丹梔逍遥散
D. 瓜蒌牛蒡汤
E. 龙胆泻肝汤

正确答案：E。龙胆泻肝汤

解析：患者，女，26岁，乳头及乳晕皮肤破裂，可诊断为乳发；火毒炽盛乳房皮肤湿烂，继而发黑溃腐，痛楚悲伤加剧，应泻火解毒，方用龙胆泻肝汤（E对）。橘叶瓜蒌散治疗乳痈（A错）。五味消毒饮主治 疔疮初起（B错）。丹栀逍遥散主治肝郁血虚，内有郁热证（C错）。瓜蒌牛蒡汤主治乳痈初起（D错）。